男，40岁，自述一年来工作压力大，几乎每晚上床后都要辗转许久才能入睡，稍有响动就醒，非常苦恼，给予每晚口服劳拉西泮1mg，睡眠有所改变，该患者合理使用苯二氮卓类药物的原则是
A. 小剂量和短疗程
B. 小剂量临时使用
C. 足剂量和长疗程
D. 小剂量和长疗程
E. 足剂量和短疗程

正确答案：A。小剂量和短疗程

解析：中年男性，工作压力大，入睡困难，睡眠维持困难，考虑诊断为失眠。临床可给予苯二氮卓类药，如劳拉西泮；褪黑素受体激动剂，如褪黑素缓释片；食欲素受体拮抗剂，如苏沃雷生；镇静类抗精神病药物，如喹硫平等治疗，治疗时注意小剂量和短疗程（一般不超过4周）（A对），动态评估。